可以用于治疗军团菌支原体衣原体的药物是
A. 人工合成素
B. 氨基糖苷类药物
C. 四环素类
D. 大环内酯类
E. 头孢类

正确答案：D。大环内酯类

解析：大环内酯类抗生素（D对）主要是通过抑制细菌蛋白质的合成来发挥抗菌作用，其抗菌谱较窄，对大多数G⁺菌、厌氧球菌和部分G⁻菌有强大抗菌活性，也对嗜肺军团菌、弯曲菌、支原体、衣原体、弓形虫、非典型分枝杆菌等也具有良好作用。人工合成素（A错）（P400）如磺胺类抗菌药，对大多数G⁺菌和G⁻菌有良好的抗菌活性，但是对支原体、立克次体和螺旋体无效。氨基糖苷类药物（B错）（P386）主要用于敏感需氧G⁻杆菌所致的全身感染。四环素类（C错）对G⁺菌和G⁻菌有抑制作用，但是由于耐药菌株日益增多和药物的不良反应，四环素类药物一般不做首选。头孢类（E错）主要用于G⁺菌和G⁻菌的感染。